乳牙早失原因不包括
A. 因晚期龋病被拔除
B. 恒牙替换乳牙
C. 恒牙异位萌出，乳牙根过早吸收脱落
D. 乳牙因外伤脱落
E. 先天牙齿缺失

正确答案：B。恒牙替换乳牙

解析：本题考查乳牙早失的原因。乳牙是儿童的咀嚼器官，同时在引导恒牙萌出、保持牙弓长度，促进颌骨发育以及维持正常颌间关系，乳牙过早缺失后，可因邻牙倾斜使得恒牙萌出间隙不足，造成恒牙错位萌出或埋伏阻生。恒牙替换乳牙为正常现象（B错，为本题的正确答案）。乳牙早失原因包括：（1）因严重的龋病、牙髓病及根尖周病变而被拔除（A对）；（2）恒牙异位萌出，造成乳牙牙根过早吸收脱落（C对）；（3）牙齿因外伤脱落（D对）；（4）先天性的牙齿缺失（E对）。